洗涤剂中对健康影响的主要成分为
A. 表面活性剂
B. 黏合剂
C. 助洗剂
D. 有毒金属
E. 碱性物质

正确答案：A。表面活性剂